关于胎动次数，下列哪项提示胎儿窘迫
A. 胎动小于10次/12小时
B. 胎动小于15次/12小时
C. 胎动小于20次/12小时
D. 胎动小于25次/12小时
E. 胎动小于30次/12小时

正确答案：A。胎动小于10次/12小时

解析：本题中关于胎动次数，提示胎儿窘迫的是胎动小于10次/12小时（A对）。